不属于化妆品所致皮肤损害的是
A. 刺激性接触性皮炎
B. 变应性接触性皮炎
C. 光变应性接触性皮炎
D. 痤疮
E. 脂溢性皮炎

正确答案：E。脂溢性皮炎